腹部损伤有腹内脏器损伤时，诊断性腹腔穿刺的诊断阳性率至少可达
A. 0.5
B. 0.8
C. 0.9
D. 0.7
E. 0.6

正确答案：C。0.9

解析：腹腔内脏器损伤时，诊断性腹腔穿刺是最有价值的检查方法，其诊断阳性率至少可达90%（C对），对判断哪类脏器损伤具有重要参考价值。